病人自觉大脑突然出现大量不自主的杂乱无章的陌生思维内容是
A. 强制性思维
B. 思维散漫
C. 强迫性思维
D. 思维奔逸
E. 被洞悉感

正确答案：A。强制性思维

解析：病人自觉大脑突然出现大量不自主的杂乱无章的陌生思维内容是强制性思维的表现（A对）。思维散漫患者表现为在交谈时，内容散漫，缺乏主题，话题转换缺乏必要的联系（B错）。强迫思维是以刻板形式反复进入患者头脑中的观念、表象或冲动思维，它们几乎总是令人痛苦的，内容常常为暴力、猥亵或毫无意义，患者往往试图抵制，但不成功（C错）。思维奔逸的患者表现为特别健谈，说话滔滔不绝，感到脑子特别灵活，就像机器加了“润滑油”一样难以停顿下来（D错）。被洞悉感又称内心被揭露感，患者感到内心所想的事情，虽然没有说出，也没有用文字书写出来，但被别人都知道了（E错）。